肛管内面纵行的粘膜皱襞
A. 肛柱
B. 肛瓣
C. 肛梳
D. 肛白线
E. 齿状线

正确答案：A。肛柱

解析：肛柱为肛管内面纵行的粘膜皱襞(A对)，肛瓣（B错）为连接各肛柱下端的半月形黏膜皱襞，肛梳(C错)为齿状线下方有一宽约1cm的环状区域，白线(D错)为肛梳下缘的一条不甚明显的环行线，齿状线(E错)为连接各肛柱下端与各肛瓣边缘的锯齿状环行线。